《中华人民共和国急性传染病管理条例》中规定报告的法定传染病有
A. 3类23种
B. 2类23种
C. 2类24种
D. 3类39种
E. 3类25种

正确答案：D。3类39种

解析：本题考查我国法定传染病数量。我国目前法定报告传染病为3类39种（D对ABCE错），其中甲类2种、乙类26种、丙类11种。